对阳热亢盛为主的实热证，应采取的治疗原则是
A. 热因热用
B. 热者寒之
C. 用热远热
D. 以热治热
E. 以热治寒

正确答案：B。热者寒之

解析：本题考查的是损其有余的含义和临床运用。对阳热亢盛为主的实热证，应采取的治疗原则是热者寒之（B对）。对于阴阳偏盛，即阴邪或阳邪过盛有余的病证，应采用“损其有余”“实则泻之”之法。如阳热亢盛的实热证，应采用“热者寒之”之法，以清泻其阳热；阴寒内盛的实寒证，应采用“寒者热之”之法，以温散其阴寒。在阴阳偏盛的病变中，一方的偏盛，可导致另一方的不足。阴寒偏盛易于损伤阳气，阳热亢盛易于耗伤阴液，即所谓“阴胜则阳病，阳胜则阴病”。故在调整阴或阳的偏盛时，应注意有没有相应的阳或阴偏衰的情况存在，若已引起另一方偏衰时，则当兼顾其不足，配合以扶阳或益阴之法。热因热用（A错）属反治法。热因热用又称“以热治热（D错）”，是指针对假热的临床表现，用热性药物来进行治疗。适用于阴寒内盛、格阳于外，反见假热之象的真寒假热证。用热远热（C错）属于因时制宜。用热远热：夏季，气候炎热，人体腠理疏松，阳气偏盛，应避免过用热性药物，以免耗伤气阴。以热治寒（E错）属于正治法。热者寒之：热者寒之又称“以寒治热”，是指热性病证出现热象，用寒凉方药进行治疗。如表热证用辛凉解表方药，里热证用苦寒清里方药治疗等。